手太阳小肠经除属、络的脏腑外，循行中联络的脏腑还有
A. 肺
B. 脾
C. 肾
D. 胃
E. 胆

正确答案：D。胃

解析：手太阳小肠经，起于手小指尺侧端，沿着手背外侧至腕部，出于尺骨茎突，直上沿着前臂外侧后缘，经尺骨鹰嘴与肱骨内上髁之间，沿上臂外侧后缘，到达肩关节，绕行肩胛部，交会于大椎，向下进入缺盆部，联络沿着食管，经过横膈，到达胃部（D对），属于小肠。